亚慢性毒性试验的目的如下述，但不包括
A. 研究受试物亚慢性毒性的特点及靶器官
B. 研究受试物的亚慢性毒性的剂量-反应关系
C. 为慢性毒性试验和致癌试验的剂量设计提供依据
D. 确定受试物的致死剂量
E. 为制定其安全限量标准提供初步参考依据

正确答案：D。确定受试物的致死剂量